按分散体系分类，液体药剂主要类型有
A. 溶液
B. 高分子溶液
C. 溶胶
D. 混悬液
E. 乳状液

正确答案：A、B、C、D。溶液；高分子溶液；溶胶；混悬液

解析：本题考查的是液体药剂的类型。按分散体系分类，液体药剂主要类型有溶液（A对）、高分子溶液（B对）、溶胶（C对）、混悬液（D对）。根据分散介质中药物粒子大小不同，液体制剂分为真溶液、胶体溶液、乳浊液和混悬液四种分散体系，其中，胶体溶液又分为高分子溶液和溶胶。